治疗小儿暑邪感冒，应首选
A. 荆防败毒散
B. 新加香薷饮
C. 银翘散
D. 三拗汤
E. 桑菊饮

正确答案：B。新加香薷饮

解析：小儿暑邪感冒证是由暑湿之邪束于肌表而致，治以清暑解表，方药为新加香薷饮（B对）。荆防败毒散（A错）其功用为疏风散寒，可用于感冒之风寒感冒证。银翘散（C错）其功用为辛凉解表，可用于风疹之邪郁肺卫证、外感咳嗽之风热咳嗽。三拗汤（D错）其功用为宣肺解表，适用于外感风寒，肺气不宣证。桑菊饮（E错）其功用为疏风清热，宣肺止咳，适用于风温初起，表热轻证。